土壤的容水性主要和哪项有关
A. 土壤颗粒粒径
B. 地面的雨雪水量
C. 土壤所含化学元素
D. 土壤中空气
E. 土壤有机物含量

正确答案：A。土壤颗粒粒径

解析：本题考查土壤的容水量。土壤的容水量与土壤颗粒粒径（A对BCDE错）有关，土壤颗粒越小，其孔隙总容积就越大，容水量也越大。